男性，56岁，l0年来肝功能一直不正常，半年来进行性消瘦，右上腹进行性胀痛，伴黄疸，B超检查证实为肝硬化肝癌。查体时不会出现的体征是
A. 脾大
B. 玫瑰疹
C. 蜘蛛病
D. 紫癜
E. 腹壁静脉曲张

正确答案：B。玫瑰疹

解析：玫瑰疹是伤寒和副伤寒具有诊断意义的特征性皮疹（B错，为本题正确答案）。肝硬化肝癌早期可出现消化系统症状和肝掌蜘蛛痣（C对）等，失代偿期可出现胸腹壁静脉曲张（E对），肝脾肿大（A对），皮肤黏膜出血导致紫癜（D对），内分泌失调，黄疸，发热，肝性脑病，移动性浊音阳性，雌激素灭活障碍，食欲减小，体重减退等。